确诊流脑的主要依据是
A. 脑脊液呈化脓性
B. 血清特异性抗体检测阳性
C. 皮肤黏膜淤点淤斑
D. 当地有流脑流行
E. 血液脑脊液涂片镜检或培养发现脑膜炎双球菌

正确答案：E。血液脑脊液涂片镜检或培养发现脑膜炎双球菌